医学心理学的研究对象为
A. 心理活动的规律的学科
B. 人类行为的科学发展
C. 疾病的发生发展的规律
D. 影响健康的有关心理问题和行为
E. 疾病的预防和治疗的原则

正确答案：D。影响健康的有关心理问题和行为

解析：根据医学心理学的定义，即医学心理学是研究心理因素与健康和疾病的关系的学科，它既关注心理社会因素在健康和疾病中的作用，也重视解决医学领域中的有关健康和疾病的心理或行为问题，可以知道医学心理学的研究对象是影响健康的有关心理问题和行为（D对）。